有关结核分枝杆菌感染概念的描述不正确的是
A. 在首次吸入含结核分枝杆菌的微滴后，是否感染取决于细菌的毒力
B. 在巨噬细胞内繁殖的结核分枝杆菌，2~12周后可发生细胞免疫反应
C. 肺泡内巨噬细胞的吞噬杀菌能力是决定是否感染结核分枝杆菌的因素
D. 结核分枝杆菌感染者仅10%左右发生结核病
E. 结核菌素试验阳性者常提示患有结核病

正确答案：E。结核菌素试验阳性者常提示患有结核病